一般情况下，主尖锉应比初尖锉大
A. 1个器械号
B. 3个器械号
C. 4个器械号
D. 5个器械号
E. 随意

正确答案：B。3个器械号

解析：本题考查根管预备方法。初尖锉为以到达根管工作长度并与根管壁有摩擦感的第一根锉，其尖部的直径代表牙本质牙骨质界处根管的大小。完成根尖预备所用的最大号锉为主尖锉，它通常要比初尖锉大2～3号（B对），至少为25号锉。主尖锉应比初尖锉大1个器械号（A错），根管预备不足，不能充分将根管中的感染物清除干净。主尖锉应比初尖锉大4个器械号（C错）或5个器械号（D错），根管壁过度预备，会使根管壁变薄，受力时牙根会易折裂。